上消化道出血最常见于
A. 胃癌
B. 胃炎
C. 胆道疾病
D. 消化性溃疡
E. 肝硬化

正确答案：D。消化性溃疡

解析：上消化道出血是指屈氏韧带以上的消化道，包括食管、胃、十二指肠或胰胆等病变引起的出血，其临床主要表现为呕血和（或）黑粪，幽门以上的出血则呕血与黑便并见，出血量少时，血红蛋白经酸作用后变成酸化正铁血红蛋白，呕吐物为咖啡色或棕褐色，往往伴有血容量减少引起急性周围循环衰竭，是常见的急症。消化性溃疡（D对）是引起上消化道出血最常见的原因。胃癌（A错）、胃炎（B错）、胆道疾病（C错）、肝硬化（E错）都可以引起上消化道出血，但都不是最常见的原因。